符合中心性发绀特点的是
A. 经按摩局部后发绀消失
B. 以唇部发绀常见
C. 全身皮肤温度低、发凉
D. 全身性发绀，皮肤温暖
E. 常出现肢体末端发绀

正确答案：D。全身性发绀，皮肤温暖

解析：中心性发绀通常由心、肺疾病引起呼吸中枢衰竭、通气与换气功能障碍、肺氧合作用不足引起。此类发绀表现全身性，但受累部位的皮肤是温暖的（D对）。周围性发绀常由血液循环障碍导致，特点表现在发绀位于肢体末端（E错）与下垂部位，如指端、唇部（B错）等。此类发绀的皮肤是冷的（C错），若给与按摩或加温，使皮肤转暖，发绀可消退（A错）。